起或止于尺骨的肌肉其中有
A. 尺侧腕屈肌
B. 肱二头肌
C. 肱桡肌
D. 肱肌
E. 尺侧腕伸肌

正确答案：D。肱肌

解析：肱肌（D对）止于尺骨粗隆。尺侧腕屈肌（A错）、肱二头肌（B错）、肱桡肌（C错）和尺侧腕伸肌（E错）的起止点均与尺骨无关。